能快速刺激机体产热增加但持续时间较短的激素
A. 胰岛素
B. 肾上腺素
C. 甲状腺素
D. 皮质醇
E. 醛固酮

正确答案：B。肾上腺素

解析：当机体遇到紧急情况时，交感-肾上腺髓质系统激活，肾上腺髓质迅速释放大量儿茶酚胺，儿茶酚胺可通过多种途径快速增强机体代谢产热：如作用于褐色脂肪组织，打断线粒体呼吸电子链传递而转化为热能；促进葡萄糖、脂肪氧化分解等。再者，儿茶酚胺半衰期极短＜20秒，大量被突触前膜再摄取。因此，肾上腺素是能快速刺激机体产热增加但持续时间较短的激素。甲状腺素（C错）主要通过体液调节机体代谢活动，如果机体在寒冷环境数周，甲状腺活动明显增强，会释放大量甲状腺激素增强机体代谢产热。因此，甲状腺激素是属于慢反应调节下的激素，持续时间长。胰岛素（A错）促进葡萄糖转化为糖原、脂肪等储能物质，需要耗能，不会产热。皮质醇（D错）、醛固酮（E错）主要作用是通过肾脏排泌功能，维持机体水盐酸碱平衡代谢，与机体产能无关。